患者关节疼痛重着，四肢痠困沉重，头重如裹，其病因是
A. 风邪
B. 寒邪
C. 暑邪
D. 湿邪
E. 痰饮

正确答案：D。湿邪

解析：“患者关节疼痛重着，四肢痠困沉重，头重如裹”是由于湿邪外袭肌表，困遏清阳，清阳不升，则头重如束布帛，湿邪阻滞经络关节，阳气不得布达，则可见肌肤不仁、关节疼痛重着（D对）。